10个月婴儿，11月3日发生腹泻，大便呈蛋花汤样，无腥臭味，每天约10次，持续3天。体温37.5～38℃，偶有咳嗽，尿量偏少。查体：体重10kg，皮肤稍干燥，眼窝稍凹陷，皮肤弹性可，粪常规未见异常。根据患儿临床表现，首日补充液体总量是
A. 300～500ml
B. 500～600ml
C. 600～700ml
D. 700～900ml
E. 900～1200ml

正确答案：E。900～1200ml